男性患者，33岁，因不慎电击导致休克，急救时除了使用心脏除颤仪或配合利多卡因外，还急需哪种药物进行急救
A. 强心苷注射
B. 酚妥拉明静脉滴注
C. 肾上腺素心内注射
D. 新斯的明肌肉注射
E. 胰岛素肌肉注射

正确答案：C。肾上腺素心内注射

解析：肾上腺素可应用于电击所致的心脏骤停，可配合心脏除颤仪或利多卡因等除颤。掌握“肾上腺素”知识点。